引起注射剂配伍变化的原因有
A. 溶剂组成改变
B. pH改变
C. 缓冲容量改变
D. 混合顺序改变
E. 离子作用

正确答案：A、B、C、D、E。溶剂组成改变；pH改变；缓冲容量改变；混合顺序改变；离子作用

解析：本题考查注射剂配伍变化。注射剂配伍变化的主要原因：1.溶剂组成改变（A对）；2.pH改变（B对）；3.缓冲容量（C对）；4.离子作用（E对）；5.直接反应；6.盐析作用；7.配合量；8.混合顺序（D对）；9.反应时间；10.氧与二氧化碳的影响；11.光敏感性；12.成分的纯度。